奇脉最常见于
A. 急性左心衰竭
B. 动脉导管未闭
C. 大量心包积液
D. 高血压病
E. 室间隔缺损

正确答案：C。大量心包积液

解析：奇脉是指吸气时脉搏明显减弱或消失，系左心室搏血量减少所致。大量心包积液（C对）时，吸气时一方面由于右心舒张受限，回心血量减少而影响右心排血量，右心室排入肺循环的血量减少；另一方面肺循环受到吸气时胸腔负压的影响，肺血管扩张，致使肺循环回流入左心房的血量减少，因而左心室排血减少，造成脉搏减弱。急性左心衰竭（A错）和重度高血压性心脏病（D错）出现交替脉。动脉导管未闭（B错）和室间隔缺损（E错）会产生血液的分流，不会产生奇脉。